测定青霉素钠含量的方法是
A. 焰色反应法
B. 干燥失重测定法
C. 分子排阻色谱法
D. 红外分光光度法
E. 反相高效液相色谱法

正确答案：E。反相高效液相色谱法

解析：本题考查青霉素钠含量测定方法。测定青霉素钠含量的方法是反相高效液相色谱法（E对）。